某女，30岁。感冒3日，症见头痛发热、恶寒身痛、鼻流清涕、咳嗽、咽干。治当疏风散寒、解表清热，宜选用的成药是
A. 荆防颗粒
B. 感冒清热颗粒
C. 九味羌活颗粒
D. 双黄连颗粒
E. 连花清瘟胶囊

正确答案：B。感冒清热颗粒

解析：本题考查的是感冒清热颗粒的功能。治当疏风散寒、解表清热，宜选用的成药是感冒清热颗粒（B对）。感冒清热颗粒【功能】疏风散寒，解表清热。荆防颗粒（A错）【功能】解表散寒，祛风胜湿。九味羌活丸（C错）【功能】疏风解表，散寒除湿。双黄连合剂（D错）【功能】疏风解表，清热解毒。连花清瘟胶囊（E错）【功能】清瘟解毒，宣肺泄热。